细菌性阴道病最常见的病原体是
A. 金黄色葡萄球菌
B. 溶血性链球菌
C. 大肠杆菌
D. 加德纳尔菌
E. 沙眼衣原体

正确答案：D。加德纳尔菌

解析：细菌性阴道病为阴道内正常菌群失调所致的一种混合感染。正常阴道内以乳杆菌占优势。细菌性阴道病时，乳杆菌减少，导致其他细菌大量繁殖，主要有加德纳菌、厌氧菌及人型支原体，其中以厌氧菌居多，厌氧菌数量可增加100～1000倍。以前因对其病原体认识不清，称之为加德纳菌阴道炎，认为最常见的病原体是加德纳菌（D对）。现按八版妇产科学观点，则以厌氧菌最多见。